下列哪种叙述是错误的
A. 吗啡的镇咳作用较哌替啶强
B. 等效量时，吗啡的呼吸抑制作用与哌替啶相似
C. 两药对平滑肌张力的影响基本相似
D. 分娩止痛可用哌替啶，而不能用吗啡
E. 吗啡的成瘾性比哌替啶强

正确答案：D。分娩止痛可用哌替啶，而不能用吗啡